我国常见的地方病有以下各项，不包括
A. 甲状腺肿大
B. 地方性氟病
C. 水俣病
D. 克汀病
E. 克山病

正确答案：C。水俣病

解析：本题考查我国常见的地方病。由于地壳表面化学元素分布的不均匀性，使某些地区的水和/或土壤中某些元素过多或过少，当地居民通过饮水、食物等途径摄入这些元素过多或过少，而引起某些特异性疾病，称为生物地球化学性疾病，属于地方病，如碘缺乏病（AD对）、地方性氟病（B对）、克山病（E对）。水俣病（C错，为本题正确答案）是慢性甲基汞中毒的典型案例，不属于地方病。